心指数为
A. 心输出量/体重
B. 心输出量/体表面积
C. 心输出量/心室舒张末期容积
D. 每搏输出量/体重
E. 每搏输出量/体表面积

正确答案：B。心输出量/体表面积